主要作用于M期的抗癌药
A. 氟尿嘧啶
B. 长春新碱
C. 环磷酰胺
D. 泼尼松龙
E. 柔红霉素

正确答案：B。长春新碱